意志的品质是指
A. 自觉性
B. 果断性
C. 自制力
D. 坚韧性
E. 以上说法均正确

正确答案：E。以上说法均正确

解析：意志的品质：自觉性、果断性、坚韧性、自制力。掌握“意志过程”知识点。